可以获得不同暴露强度与疾病的关系，也可以观察一种暴露因素与多种疾病的关系为下列哪种流行病学调查的特点
A. 病例-对照研究
B. 群组研究
C. 常规资料分析
D. 横断面研究
E. 纵向研究

正确答案：B。群组研究

解析：群组研究的特点是可以获得不同暴露强度与疾病的关系，也可以观察一种暴露因素与多种疾病的关系。掌握“口腔流行病学概述及研究方法”知识点。